下列哪项属于口腔健康教育任务的范畴
A. 制定危险因素预防政策
B. 改进服务与防护和提高公众及专业人员认识
C. 深化口腔健康教育内容，扩大教育面
D. 加强国际国内和各级部门间的合作
E. 组织社区口腔健康促进示范项目

正确答案：C。深化口腔健康教育内容，扩大教育面

解析：本题考查口腔健康教育。口腔健康教育的任务主要有以下5个方面：①提高社会人群口腔预防保健的知识水平，破除不卫生、不文明的旧观念，建立口腔健康行为，不断提高生活质量，促进全民族的口腔健康；②深化口腔健康教育内容，扩大教育面（C对）。增加卫生、医疗人员的口腔预防知识，强化口腔健康教育意识，提高口腔健康教育的能力；③引起社会各方人员对口腔健康问题的关注，为寻求口腔预防保健资源做好准备；④争取各级行政领导与卫生行政领导的支持，以便合理分配有限的资源。制定方针、政策，推动防治方案顺利进行；⑤传递最新的科学信息，积极参加新的口腔保健措施的应用与推广。